男，23岁。大四学生。自述从上大学开始出现与人沟通时紧张、心慌、表达不流畅的现象；因临近毕业需要面试，前来寻求心理帮助。心理治疗师布置了—个面试的现场，让其直接面对“面试官”陈述自己的职业倾向和胜任能力。这种治疗方法为
A. 系统脱敏法
B. 示范法
C. 催眠疗法
D. 厌恶疗法
E. 满灌疗法

正确答案：E。满灌疗法

解析：系统脱敏法（A错）是使病人按由轻到重的程度逐渐面对所惧怕的情况。厌恶疗法（D错）是一种通过惩罚来消除适应不良行为的治疗方法。当某种适应不良行为即将出现或正在出现时，当即给予一定的痛苦刺激，如轻微的电击、针刺或催吐剂，使其产生厌恶的主观体验。满灌疗法（E对）是让病人一开始就进入焦虑等级表中最高的情境中，并一直停留在该情境当中，直到焦虑消失为止。该生与人沟通时紧张、心慌、表达不流畅，即将面临面试。心理治疗师布置了—个面试的现场，让其直接面对“面试官”陈述自己的职业倾向和胜任能力。这种治疗方法为满灌疗法（E对）。